下列各项，不属津布散部位的是
A. 皮肤
B. 肌肉
C. 孔窍
D. 血脉
E. 脑髓

正确答案：E。脑髓

解析：本题主要考查了津、液的区别。津布散于体表皮肤（A对）、肌肉（B对）和孔窍（C对），并能深入血脉之内（D对）。脑、髓（E错，为本题正确答案）、骨节、脏腑是液的灌注部位，液的质地浓稠，流动性小，主要起濡养作用。